男性，68岁。持续心房纤颤6年，一直服用地高辛治疗。近1周感心悸头晕。查体：心率41次/分，律齐。最可能的诊断是
A. 窦性心动过缓
B. 心房扑动6：1下传
C. 心房纤颤合并完全性房室传导阻滞
D. 房性逸搏心律
E. 病态窦房结综合征

正确答案：C。心房纤颤合并完全性房室传导阻滞

解析：患者老年男性，持续心房纤颤6年，长期服用地高辛控制心室率。查体：心率41次／分，律齐（正常值60～100次/分，房颤患者如心室率变为慢而规则，提示可能出现完全性房室传导阻滞），近1周感心悸头晕（考虑缓慢心率导致的脑供血不足），故最可能的诊断是心房纤颤合并完全性房室传导阻滞（C对）。窦性心动过缓（P182-P183）（A错）是指成人窦性心律的频率低于60次/分，常见于健康的青年人、运动员与睡眠状态，心悸头晕等症状较少见。典型房扑（P187）的频率常为250～300次/分，且房室传导多为2：1，心房扑动6：1下传（B错）不常见。当高位节律点发生病变或受到抑制而出现停搏或节律明显减慢时，或者因传导障碍而不能下传时，或其他原因造成长的间歇时，低位起搏点发出冲动激动激动心房或心室，仅发生1～2个称为逸搏，连续3个以上称为逸搏心律。按发生的部位分为房性、房室交界性和室性逸搏。